牙体缺损修复体作为一种治疗装置作用为
A. 阻止牙体病变进一步发展
B. 恢复正常生理功能
C. 预防牙体、牙周支持组织病变的发生
D. 保持口颌系统健康和各部协调
E. 以上均为其作用

正确答案：E。以上均为其作用

解析：本题考查牙体缺损的修复原则。牙体缺损修复体是采用某种材料制成，借粘固剂等固定在经过预备的患牙上，以恢复牙体形态和功能的人工替代体，其作为一种治疗装置不仅可以阻止牙体病变进一步发展（A对）还可以适度恢复其正常生理功能（B对）和预防牙体、牙周支持组织病变的发生（C对）。恢复牙形态的主要目的是恢复牙的生理功能，并有利于保护牙和牙周组织的健康，而患牙形态的正确恢复有利于恢复患者原有咬合，从而保持口颌系统健康和各部协调（D对）。（ABCD均对，故E为本题的正确答案）。